有机磷中毒时应用阿托品，下列哪项是错误的
A. 用量应根据病情适当使用
B. 达到阿托品化后减少阿托品的剂量或停用
C. 与胆碱酯酶复活剂合用时，阿托品的剂量应减少
D. 重度中毒时应静脉给药
E. 当出现阿托品中毒时应立即间隔给药

正确答案：E。当出现阿托品中毒时应立即间隔给药